口腔尖锐湿疣的病原体不包括
A. 6型HPV
B. 11型HPV
C. 16型HPV
D. 18型HPV
E. HBV

正确答案：E。HBV

解析：口腔尖锐湿疣是肛门与生殖器部位尖锐湿疣的口腔表现。通常为6、11、16、18型人类乳头瘤病毒感染。HBV为乙肝病毒。掌握“乳头状瘤及牙龈瘤”知识点。